1型糖尿病人牙周炎好发于
A. 上颌切牙
B. 下颌切牙
C. 上、下颌切牙和双尖牙
D. 上、下颌切牙和第一磨牙
E. 上、下颌切牙和第二磨牙

正确答案：D。上、下颌切牙和第一磨牙

解析：本题考查1型糖尿病牙周炎的好发牙齿。糖尿病与牙周病关系密切，有糖尿病的患者牙周病发生率明显高于血糖正常者。1型糖尿病与快速进展性牙周炎基因相关联，两种疾病常伴发于同一患者。快速进展性牙周炎属于侵袭性牙周炎，具有牙位特异性，局限于第一磨牙和上下切牙，多为左右对称。因此，1型糖尿病人牙周炎好发于上、下颌切牙和第一磨牙（D对ABCE均错）。